用硫置换巴比妥类分子中2位上的氧，则
A. 脂溶性增加
B. 起效慢
C. 起效快
D. 作用时间长
E. 作用时间短

正确答案：A、C、E。脂溶性增加；起效快；作用时间短

解析：本题考查巴比妥类药物。用硫置换巴比妥类分子中2位上的氧，则脂溶性增加（A对）、起效快（C对）、作用时间短（E对）。巴比妥类药物2位碳上的氧被硫取代，形成如硫喷妥，其脂溶性增加，且易透过血脑屏障，故起效很快（B错），同时脑中药物浓度下降快，作用持续时间短（D错）。